唇、面、腭裂的发病原因
A. 与遗传无关
B. 单一遗传性因素所致
C. 病因未明了，受多因素影响
D. 与内分泌的影响无关
E. 与环境密切相关

正确答案：C。病因未明了，受多因素影响

解析：引起胚突发育和融合障碍的确切原因和发病机制，目前尚未完全明了，可能为多种因素的影响而非单一因素所致。可能的因素如下：遗传因素；营养因素；感染和损伤；内分泌的影响；药物因素；物理因素；烟酒因素等。掌握“唇腭裂概述”知识点。